患者因皮肤疮痍破溃而引发水肿，肿势自颜面渐及全身，皮肤光亮，尿少色赤，小便不利，发热咽红，舌红苔薄黄，脉滑数。治疗应首选
A. 越婢加术汤合桑白皮汤
B. 麻黄连翘赤小豆汤合五味消毒饮
C. 麻黄连翘赤小豆汤合五皮散
D. 麻黄连翘赤小豆汤合猪苓汤
E. 实脾饮合五味消毒饮

正确答案：B。麻黄连翘赤小豆汤合五味消毒饮

解析：患者因皮肤疮痍破溃而引发水肿，以水肿为主症。肺主皮毛；湿毒未能及时清解消散，内归肺脾，使中焦脾胃不能运化水湿，失去升清降浊之能，而眼睑浮肿，延及全身，肺不能通调水道而小便不利；湿毒不解则身发疮痍；湿毒内侵，营卫不和故恶寒发热；咽红，舌红苔薄黄，脉滑数为风邪夹湿毒所致。故辨证为湿毒浸淫证，治宜宣肺解毒，利湿消肿，代表方麻黄连翘赤小豆汤合五味消毒饮（B对）。越婢加术汤合桑白皮汤用于治疗喘证痰热郁肺证（A错）。麻黄连翘赤小豆汤功能宣肺利尿，常合五味消毒饮，治疗水肿湿毒浸淫证。五皮散功能利水消肿，理气健脾，常合葶苈大枣泻肺汤治疗湿热壅盛证兼见气粗喘满，倚息不得卧，脉弦有力者（C错）。猪苓汤具有利水，养阴，清热之功效。主治水热互结证（D错）。实脾饮用于水肿阴水脾阳虚衰证。五味消毒饮主治疔疮初起，发热恶寒，疮形如粟，坚硬根深，状如铆钉，以及痈疡疖肿，红肿热痛（E错）。